哪项不是固定义齿的组成成分
A. 固位体
B. 基牙
C. 桥体
D. 连接体
E. 以上都是

正确答案：B。基牙

解析：本题考查固定局部义齿的组成。基牙（B错，为本题正确答案）不是固定义齿的组成成分。固定义齿由固位体（A对）、桥体（C对）、连接体（D对）三部分组成，靠粘固剂等与基牙或种植体连接在一起。其中固位体是固定桥粘固或粘接于基牙上的部分，固定桥靠固位体与基牙连接在一起并将（牙合）力通过固位体传给基牙；桥体是固定桥恢复缺失牙的形态和功能的部分；连接体是桥体与固位体的连接部分。